某病人存在“翼状肩”体征，可考虑是以下哪块肌瘫痪
A. 三角肌
B. 背阔肌
C. 斜方肌
D. 前锯肌
E. 菱形肌

正确答案：D。前锯肌

解析：前锯肌（D对）瘫痪时，肩胛骨内侧缘与下角离开胸廓而突出于皮下，即出现“翼状肩”体征。